可被称为抗体依赖细胞介导的细胞毒作用（ADCC）的是
A. 穿越胎盘
B. 调理吞噬
C. 穿越黏膜
D. 介导细胞杀伤
E. 介导Ⅰ型超敏反应

正确答案：D。介导细胞杀伤

解析：介导细胞杀伤：IgG与细菌、肿瘤或病毒感染的靶细胞结合后，可通过其Fc段与NK细胞表面的IgGFc受体结合，增强NK细胞对靶细胞的非特异性杀伤。该作用称为抗体依赖细胞介导的细胞毒作用（ADCC）。掌握“免疫球蛋白的类型及功能”知识点。